疮口呈空腔或伴瘘管，脓水稀薄，夹有败絮样物，见于
A. 瘰疬溃疡
B. 岩性溃疡
C. 附骨疽溃疡
D. 压疮溃疡
E. 梅毒溃瘍

正确答案：A。瘰疬溃疡

解析：疮痨性溃疡：疮口多呈凹陷形或潜行空洞或漏管，疮面肉色不鲜，脓水清稀，并夹有败絮状物，疮口愈合缓慢或反复溃破，经久难愈。而瘰疬溃疡属于疮痨性溃疡（A对）。岩性溃疡：疮面多呈翻花状如岩穴，有的在溃疡底部见有珍珠样结节，内有紫黑坏死组织，渗流血水，伴腥臭味（B错）。附骨疽是一种毒气深沉、附着于骨的化脓性疾病化脓性溃疡：疮面边沿整齐，周围皮肤微有红肿，一般口大底小，内有少量脓性分泌物（C错）。压迫性溃疡（缺血性溃疡）：初期皮肤暗紫，很快变黑并坏死，滋水、液化、腐烂，脓液有臭味，可深及筋膜、肌肉、骨膜。多见于褥疮。（D错）。梅毒性溃疡：多呈半月形，边缘整齐，坚硬削直如凿，略微内凹，基底面高低不平，存有稀薄臭秽分泌物（E错）。